防止血栓性疾病的药物包括
A. 肝素
B. 阿司匹林
C. 华法林
D. 链激酶
E. 氨甲苯酸

正确答案：A、B、C、D。肝素；阿司匹林；华法林；链激酶

解析：本题考查肝素。防止血栓性疾病的药物包括肝素（A对）、阿司匹林（B对）、华法林（C对）、链激酶（D对）。肝素与华法林均是抗凝血药，能够防止血栓形成。阿司匹林是抗血小板药。链激酶是溶栓药，能够溶解血栓。氨甲苯酸（E错）是促凝血药，使用时可能会促进血栓形成。